获得执业医师资格或执业助理医师资格后，应在几年内注册
A. 1年
B. 2年
C. 半年
D. 3年
E. 5年

正确答案：B。2年

解析：获得执业医师资格或执业助理医师资格后，应在2年（B对）内注册，2年内未注册者，申请注册时，还应提交在省级以上卫生行政部门指定的机构接受连续6个月以上的培训，并经考核合格的证明。